红景天既是中医的常用药，又是藏医的习用药，其甘补苦泄，平而偏凉，具有的功效有
A. 清热解毒
B. 益气
C. 平喘
D. 养血益气
E. 活血通脉

正确答案：B、C、E。益气；平喘；活血通脉

解析：本题考查的是红景天的功效。红景天既是中医的常用药，又是藏医的习用药，其甘补苦泄，平而偏凉，具有的功效有益气（B对）、平喘（C对）与活血通脉（E对）。红景天：【功效】益气，平喘，活血通脉。绞股蓝：【功效】健脾益气，祛痰止咳，清热解毒（A错）。大枣：【功效】补中益气，养血（D错）安神，缓和药性。